患者，男，7岁。右下后牙菜花样溃疡2个月，溃疡约2.8cm×3cm大小，临近溃疡的牙齿略松动，右颈上部触及一淋巴结，约1.5cm×2.0cm大小，质偏硬、尚可活动，未发现远处转移。根据上述症状，该患者最可能的诊断是
A. 颊癌
B. 牙龈癌
C. 口底癌
D. 舌癌
E. 腭癌

正确答案：B。牙龈癌

解析：“右下后牙菜花样溃疡”是本题重要的诊断依据。牙龈癌多为分化度较高的鳞状细胞癌，生长较慢，以溃疡型为最多见。掌握“鳞状细胞癌概述及舌癌、牙龈癌”知识点。